男性，30岁，主诉：牙龈自动出血。疼痛3天余，并伴有低热，该患者最可能的诊断是
A. 牙间乳头炎
B. 肥大性龈炎
C. 急性坏死性龈炎
D. 疱疹性龈口炎
E. 青少年牙周炎

正确答案：C。急性坏死性龈炎

解析：本题考查急性坏死性溃疡性龈炎的临床表现。急性坏死性溃疡性龈炎以龈乳头的坏死为其特征性损害，上覆有灰白色污秽的坏死物，龈缘如虫蚀状，坏死去出现灰白色假膜，易于擦去，龈乳头破坏后与龈缘成一直线，如刀切状，病损不波及附着龈，患处牙龈极易出血，疼痛明显，有典型的腐败性口臭，重症患者可有低热（C对）。急性龈乳头炎表现为牙龈乳头发红肿胀，探触和吸吮有出血，有自发性的胀痛和明显的探触痛，牙可有叩痛（A错）。肥大性牙龈炎一般无疼痛（B错）。急性疱疹性龈炎为成簇的小水疱，疱破溃后成为大片浅表溃疡，可伴有皮肤损害（D错）。青少年牙周炎无自动出血和疼痛的症状（E错）。